以下关于描述性研究正确地是
A. 主要描述分布的三大特征：时间，地区，人群
B. 无需设立对照
C. 现况研究在确定因果联系时受到限制
D. 是分析流行病学的基础
E. 以上均是

正确答案：E。以上均是

解析：本题考查描述性研究的特点。描述性研究是分析性研究的基础，是从时间、空间（地区）和人间（人群）分布三个方面对正在调查的或已有的资料进行描述，有助于阐明疾病或者健康事件的分布特征，揭示疾病或健康状态的分布及发生发展的规律。描述性研究的特点为：1.现况研究一般在设计阶段不设对照组；2.现况研究的特定时间；3.现况研究在确定因果联系时受到限制（E对ABCD错）；4.对研究对象固有的暴露因素可以作因果推断；5.现况研究用现在的暴露（特征）来替代或估计过去情况的条件；6.现况研究定期重复进行可以获得发病率资料。